恶性程度最高的体表肿瘤是
A. 皮肤乳头状癌
B. 皮肤鳞状细胞癌
C. 恶性黑色素瘤
D. 纤维肉瘤
E. 皮肤基底细胞癌

正确答案：C。恶性黑色素瘤

解析：恶性黑色素瘤（C对）为高度恶性肿瘤，发展迅速，若作不彻底切除或切取活检，可迅速出现卫星结节及转移。皮肤乳头状癌（A错）由皮肤乳头状瘤恶变而来，局部浸润生长，中度恶性。皮肤鳞状细胞癌（B错）恶性程度较低，可局部浸润及淋巴结转移。纤维肉瘤（D错）好发于四肢皮下组织，低度恶性，常具有假包膜。皮肤基底细胞癌（E错）好发于老年人头面部，很少发生转移，临床上呈低度恶性的经过。